女，23岁，2个月来时有心悸易出汗体重减轻约3kg，查体：血压126/68mmHg，中等体型，皮肤微潮，双手轻度细颤，无突眼，甲状腺Ⅰ°肿大，未闻及血管杂音，心率94次/分，律齐。为证实是否为甲状腺功能亢进症，应检查
A. 血TSH、FT₃、FT₄
B. 甲状腺I¹³¹摄取率
C. 甲状腺核素扫描
D. 抗甲状腺抗体
E. 甲状腺刺激免疫球蛋白

正确答案：A。血TSH、FT₃、FT₄

解析：引起甲亢一系列临床表现的关键为血液循环中甲状腺激素过多，导致神经、循环、消化等系统兴奋性增高和代谢亢进。甲状腺激素包括T₃和T₄，其中以游离状态存在的T₃、T₄（FT₃、FT₄）发挥主要作用。由于甲状腺激素分泌增多，负反馈性抑制促甲状腺激素（TSH）分泌，导致血液中TSH减少。因此，为证实是否为甲状腺功能亢进症，应检查血TSH、FT₃、FT₄（A对），甲亢患者血中FT₃、FT₄升高，TSH降低。甲状腺¹³¹I摄取率（B错）目前已经被sTSH（敏感TSH）测定技术所替代。甲状腺核素扫描（P684-P685）（C错）主要用于高功能腺瘤的诊断。抗甲状腺抗体（D错）是鉴别甲亢病因、辅助Graves病诊断的指标之一；甲状腺刺激免疫球蛋白（E错）测定主要用于评价抗甲状腺药物治疗的疗效、确定停药时机、预测复发等。